健康管理概念产生之初，健康管理的内容为
A. 围绕个体健康危险因素的测量和管理等活动展开
B. 围绕个体健康危险因素的测量、评价和管理等活动展开
C. 围绕个体健康危险因素的评价和管理等活动展开
D. 围绕个体健康危险因素的测量和评价等活动展开
E. 围绕个体健康危险因素的测量等活动展开

正确答案：B。围绕个体健康危险因素的测量、评价和管理等活动展开

解析：本题考查健康管理的内容。健康管理的概念产生之初，健康管理的内容主要围绕个体健康危险因素的测量、评价和管理等活动展开（B对ACDE错）。随着健康管理研究和实践活动的不断拓展，其管理对象、内容、范围和管理手段开始向多方面拓展。